河豚毒素最主要的毒作用是
A. 引起颅神经损害
B. 引起中毒性休克
C. 引起随意肌进行麻痹
D. 引起肾功能急性衰竭
E. 以上都不是

正确答案：A。引起颅神经损害